男性，63岁。吸烟。反复咳嗽、咳白色泡沫痰20余年，气促10年，近2天因受凉后出现发热伴咳黄脓痰，气喘不能平卧。查体：双肺语颤减弱，可闻及散在干湿啰音，心界缩小，心率110次/分。该患者最可能的诊断是
A. 慢性支气管炎急性发作
B. 支气管哮喘
C. 支气管扩张
D. 肺结核
E. 肺癌

正确答案：A。慢性支气管炎急性发作

解析：患者为老年男性，有吸烟史（为慢性支气管炎的重要发病因素），咳嗽、咳痰伴有气促（为慢性支气管炎的典型症状），患者可初步诊断为慢性支气管炎。受凉后出现发热伴咳黄脓痰，气喘不能平卧，提示慢性支气管炎急性发作（A对）。支气管哮喘（P29）（B错）典型症状为发作性伴有哮鸣音的呼气性呼吸困难，可在数分钟内发作，经数小时至数天，用支气管舒张剂或自行缓解，夜间及凌晨发作和加重常是哮喘的特征之一。支气管扩张（P37）（C错）的典型的症状有慢性咳嗽、咳大量脓痰和反复咯血，背部可闻及固定而持久的局限湿啰音。肺结核（P65）（D错）有较密切的肺结核接触史，起病可急可缓，多有午后低热、盗汗、乏力等全身结核症状，胸部X线可见典型的影像特征。肺癌（P77）（E错）症状多表现为刺激性干咳或过去有咳嗽史，近期咳嗽性质发生改变，痰中带血或咯血，胸痛胸闷，发热，消瘦，恶病质等。